免疫的功能不是
A. 免疫防御
B. 免疫监视
C. 免疫稳定
D. 免疫耐受
E. 抗感染免疫

正确答案：D。免疫耐受

解析：本题考查基本概念。免疫的功能不是免疫耐受（D错，为本题正确答案）。免疫系统具有三个功能：①免疫防御（A对）功能：防止外界病原体的入侵及清除已入侵的病原体及有害的生物性分子；②免疫自稳（C对）功能：清除体内衰老的细胞；③免疫监视（B对）功能：监督机体内环境出现的突变细胞及早期肿瘤，并予以清除。抗感染免疫（E对）属于免疫防御功能。